关于眼用制剂中药吸收途径及其影响因素的说法，正确的有
A. 适当增加滴眼剂的黏度有利于药物吸收
B. 经角膜吸收的药物主要起局部治疗作用
C. 结合膜吸收是药物进入体循环的主要途径
D. 眼用制剂的刺激性，可能影响药物的吸收与利用
E. 从眼睑缝溢出的药液可能会流入鼻腔或口腔吸收产生全身作用

正确答案：A、B、C、D、E。适当增加滴眼剂的黏度有利于药物吸收；经角膜吸收的药物主要起局部治疗作用；结合膜吸收是药物进入体循环的主要途径；眼用制剂的刺激性，可能影响药物的吸收与利用；从眼睑缝溢出的药液可能会流入鼻腔或口腔吸收产生全身作用

解析：本题考查的是眼用制剂中药物吸收的途径及影响吸收的因素。关于眼用制剂中药吸收途径及其影响因素的说法，正确的有适当增加滴眼剂的黏度有利于药物吸收（A对）、经角膜吸收的药物主要起局部治疗作用（B对）、结合膜吸收是药物进入体循环的主要途径（C对）、眼用制剂的刺激性，可能影响药物的吸收与利用（D对）与从眼睑缝溢出的药液可能会流入鼻腔或口腔吸收产生全身作用（E对）。眼用制剂中药物吸收的途径及影响吸收的因素：1.眼的药物吸收途径：眼的药物吸收途径主要有两条：即药物进入结膜囊内主要经过角膜和结膜两条途径吸收。角膜吸收是眼局部用药的有效吸收途径，即药物与角膜接触后，透过角膜进入房水并经前房至虹膜和睫状肌，药物主要被局部血管网吸收发挥局部治疗作用。药物经结膜吸收是药物进入体循环的主要途径，通过巩膜，可达到眼球后部。2.影响眼用制剂中药物吸收的因素：（1）药物从眼睑缝隙的损失：溢出的药液大部分沿面颊流下，或从排出器官进入鼻腔或口腔，进而进入胃肠道。这也是某些作用强烈的眼用制剂，用药后有明显的全身作用的机制之一。（2）药物的外周血管消除：可能影响药效，亦可能引起全身性副作用。（3）眼用制剂的pH及药物的pKₐ：眼用制剂的pH影响不同pKₐ药物的解离，进而影响药物的吸收。（4）刺激性：眼用制剂的刺激性，不仅给眼部带来不适，而且使结膜的血管和淋巴管扩张，增加了药物从外周血管的消除，并使泪液增加而稀释药物，影响药物的眼部吸收与利用而降低药效。（5）表面张力：滴眼剂的表面张力越小，越有利于滴眼剂与泪液的混合，也有利于药物与角膜的接触，使药物易于渗入。（6）黏度：增加黏度可延长滴眼剂中药物与角膜接触的时间，有利于吸收。